腹直肌
A. 完全被腹直肌鞘包绕
B. 为上、下等宽的带形腹肌
C. 全长有3~4个腱划
D. 腱划与腹直肌鞘前层疏松结合
E. 无

正确答案：C。全长有3~4个腱划

解析：腹直肌不与腹直肌鞘的后层愈合，而非完全被腹直肌鞘包绕（A错）。腹直肌为上宽下窄的带形腹肌，而非上下等宽的带形腹肌（B错）。腹直肌全长有3～4个腱划（C对），且腱划与腹直肌鞘的前层紧密结合，而非疏松结合（D错）。